某女生，3岁时身高开始落后，11岁时下降到正常标准的P₁₀以下；接受治疗后，身高迅猛增长，并在16岁时恢复到P₅₀左右。造成此女生出现身高生长落后的原因最可能是
A. 雌激素分泌不足
B. 胰岛素分泌不足
C. 肾上腺素分泌不足
D. 甲状腺索功能低下
E. 褪黑素分泌不足

正确答案：D。甲状腺索功能低下